为防止乙肝病毒携带者在入学时受到歧视，国务院废除了入学检测“乙肝五项”，明确规定禁止将携带乙肝病毒作为入学的限制条件，该举措体现的是传染病防治的什么医学伦理
A. 公众利益为重
B. 传染病患者的人权和尊严
C. 遵循社会公平原则
D. 进行传染病防治的宣传
E. 进行检测与上报

正确答案：B。传染病患者的人权和尊严

解析：在世俗观念中，传染病患者，特别是性病、艾滋病患者，往往受到不应有的歧视、排挤，有时甚至发生惨剧。医务人员应该认识到传染病患者是传染性疾病的受害者，并不能为疾病、疾病传染负责，指责、歧视、排挤是错误的做法。在工作中，公共卫生工作者应尊重传染性疾病及疑似患者的各项正当权益。题中为防止乙肝病毒携带者在入学时受到歧视，国务院废除了入学检测“乙肝五项”，明确规定禁止将携带乙肝病毒作为入学的限制条件，该举措体现的是传染病防治的传染病患者的人权和尊严（B对）的医学伦理。